女，50岁。饱餐后饮酒出现上腹部持续疼痛6小时，呈腰背部放射。前屈位可稍缓解，呕吐物为胃内容物，呕吐后不缓解。查体：T37.1℃，P112次/分，R24次/分，BP100/70mmHg。全腹压痛，以上腹为著，可见肌紧张，无反跳痛，Murphy征阴性，肠鸣音2次/分。腹部B超提示：胆囊结石，胰腺肿大，回声减低。最有可能的诊断是
A. 急性机械性肠梗阻
B. 急性胆囊炎
C. 急性胰腺炎
D. 急性胃炎
E. 溃疡穿孔

正确答案：C。急性胰腺炎

解析：患者有胆囊结石（胆道疾病高危因素），饱餐后饮酒（AP常见诱因）出现上腹部持续疼痛，向腰背部放射，呕吐物为胃内容物，呕吐后不缓解（AP特异症状）。全腹压痛，以上腹为著，可见肌紧张，肠鸣音减弱（腹膜炎体征）。轻度发热，脉搏细速、血压下降。胰腺肿大，回声减低（胰腺有水肿）。最有可能的诊断是急性胰腺炎（C对）。急性机械性肠梗阻（A错）常有腹痛、腹胀、呕吐、排气排便停止。急性胆囊炎（B错）进食油腻食物后发作右上腹绞痛，向右肩和右腰背部放射。体检时右上腹有压痛、反跳痛、肌紧张，Murphy征阳性。急性胃炎（D错）无上述特异表现。溃疡穿孔（E错）突发的中上腹剧烈刀割样痛或烧灼样痛。